患者，女，27岁，已婚。经来量多，周期23天，经期7天，妇科检查示子宫前位，如鸡蛋大小，质中，双侧附件(一)。应首先考虑的是
A. 血崩
B. 经乱
C. 月经先期
D. 癥瘕出血
E. 月经过多

正确答案：E。月经过多

解析：月经正常周期为21-35天，经期为3-7天，患者周期23天，周期7天，属于正常，患者经量增多，经量明显增多，而周期正常者为月经过多（E对）。血崩即指崩中，崩中为月经周期、经期、经量发生严重失常的病证，是指经血非时暴下不止（A错）。经乱即指月经先后无定期，是指月经周期时或提前时或延后7天以上，连续3个周期以上者（B错）。月经先期是指月经周期提前7天以上，甚至10余日一行，连续2个周期以上者（C错）。癥瘕是指妇人下腹结块，伴有或胀、或痛、或满、或异常出血者，癥瘕多见月经量多，经期延长，子宫增大，患者子宫大小正常（D错）。